为比较不同质子泵抑制剂治疗十二指肠溃疡的经济性，将药物治疗的成本与产生的效用指标以货币进行评估，此药物经济学评价方法是
A. 成本-效益分析
B. 最小成本分析
C. 成本-效果分析
D. 成本-效用分析
E. 成本-费用分析

正确答案：A。成本-效益分析

解析：本题考查药物经济学评价方法。为比较不同质子泵抑制剂治疗十二指肠溃疡的经济性，将药物治疗的成本与产生的效用指标以货币进行评估，此药物经济学评价方法是成本-效益分析（A对）。成本-效益分析是指将药物治疗的成本与所产生的效益归化为以货币为单位的数字，用以评估药物治疗方案的经济性。成本-效果分析（C错）与成本-效益分析的差异在于，药物治疗的效果不以货币为单位表示，而是用其他量化的方法表达治疗目的，如延长患者生命时间等。最小成本分析（B错）是指用于两种或多种药物治疗方案的选择，虽然只对成本进行量化分析，但也需要考虑效果。最小成本分析可以为总体医疗费用的控制和医疗资源优化配置提供基本信息。成本-效用分析（D错）是更细化的成本-效果分析，效用指标是指患者对某种药物治疗后所带来的健康状况的偏好，主要为质量调整生命年或质量调整预期寿命两种，分别是生命年数或预期生命年数乘以这段时间内的健康效用值。